需代谢活化后才具有致癌活性的致癌物为
A. 直接致癌物
B. 前致癌物
C. 助致癌物
D. 促长剂
E. 进展剂

正确答案：B。前致癌物